接触铅机会最大的行业是
A. 印染
B. 电池制造
C. 塑料生产
D. 制鞋行业

正确答案：B。电池制造

解析：本题考查铅的接触机会。在工业中，有大量接触铅的行业，包括：铅矿开采和冶炼；蓄电池制造（B对ACD错）和维修；制造含铅耐腐蚀化工设备、管道、构件等；放射性防护材料制造；印刷行业；电子与电力行业；军火制造；化工行业；食品行业；油漆生产颜料行业；塑料工业；橡胶工业；医药工业；农药工业；玻璃陶瓷工业；自来水管道和暖气管道连接铅封等。